临床中检查牙龈出血指数（GBI）前，一般不能检查
A. 简化软垢指数（DI-S）
B. 简化牙石指数（CI-S）
C. 牙龈指数（GI）
D. 菌斑指数（PLI）
E. 社区牙周指数（CPI）

正确答案：D。菌斑指数（PLI）

解析：检查时使用牙周探针轻探牙龈，观察出血情况。检查牙龈出血指数前，一般不能检查菌斑指数，因使用染色剂后会影响牙龈出血情况的辨别。掌握“牙周病流行病学及分级预防”知识点。